患者男性28岁，因右下8智齿冠周炎引起咬肌间隙脓肿需切开引流，下面说法错误的是
A. 切开引流即可从口内进行，也可从口外进行
B. 口内引流与口外引流效果相近，口内切口更为隐蔽
C. 口内切口选择在翼下颌韧带稍外侧
D. 口外切口选择在下颌支后缘并绕过下颌角，距下颌下缘2cm处
E. 切开后应注意探查升支骨面是否正常

正确答案：B。口内引流与口外引流效果相近，口内切口更为隐蔽

解析：本题考查咬肌间隙脓肿切开引流。咬肌间隙脓肿切开引流的途径有口内和口外切开两条（A对）。口内可从翼下颌皱襞稍外侧切开（C对），引流口常在脓腔前上份，体位引流不畅，炎症不易控制，发生边缘性骨髓炎的机会也相应增加，效果不如口外切开（B错，为本题的正确答案）。口外切口从下颌支后缘绕过下颌角，距下颌下缘2cm处切开，切口长约3～5cm（D对）。若未能及时引流，长期脓液蓄积，易形成下颌支的边缘性骨髓炎，切开后应注意探查升支骨面是否正常（E对）。